男，48岁。突发高热，39度，伴寒战。自述头痛乏力全身酸痛。査体可见眼结膜充血，双侧腓肠肌压痛，腹股沟腋窝淋巴结肿大。当地正流行钩端螺旋体病，最有可能的诊断是
A. 伤寒
B. 肺炎
C. 钩端螺旋体病
D. 流行性出血热
E. 败血症

正确答案：C。钩端螺旋体病

解析：48岁男性患者，发病地区流行钩端螺旋体病（有疫区接触史），突发高热体温达39℃伴寒战，有头痛乏力全身酸痛症状，査体见眼结膜充血，双侧腓肠肌压痛，腹股沟腋窝淋巴结肿大（出现中毒性败血症症状和体征），结合患者的临床表现和个人史，最有可能的诊断是钩端螺旋体病（C对）。钩端螺旋体病是人感染钩端螺旋体后，致病性钩端螺旋体通过皮肤、黏膜侵入人体，并经淋巴系统或直接进入血流引起钩端螺旋体血症。伤寒（A错）由伤寒沙门菌引起，患者可出现持续高热、肝脾肿大、玫瑰疹，可有表情淡漠的伤寒面容等（P119）。肺炎（B错）可由多种病原体引起，症状轻重不一，常见症状为咳嗽、咳痰，可有呼吸困难，呼吸窘迫，大多数患者有发热、呼吸频率增快，也可闻及肺部湿性啰音等（八版内科学P42）。流行性出血热（肾综合征出血热）（D错）是由汉坦病毒导致的出血热疾病，可有明显的地区性和季节性，临床以发热、低血压休克、充血出血和肾损害为主要表现（八版传染病学P77）。败血症（E错）指致病菌侵入血流后，在其中大量生长繁殖并产生毒性产物，而引起全身性中毒症状，主要表现为为寒战、发热、严重毒血症状、皮肤瘀点、肝脾肿大和白细胞数增高等系统性表现，败血症的病原可为多种细菌或真菌（八版传染病学P225-P226）。